球形AED小于（）㎛的粉尘离子称为可吸入性粉尘
A. 5
B. 10
C. 15
D. 20

正确答案：C。15

解析：本题考查不同粒径的粉尘的分类。尘粒的空气动力学直径（AED）是指某一种类的粉尘粒子，不论其形状、大小和密度如何，如果它在空气中的沉降速度与一种密度为1的球形粒子的沉降速度一样时，则这种球形粒子的直径即为该种粉尘粒子的空气动力学直径。同一空气动力学直径的尘粒，在空气中具有相同的沉降速度和悬浮时间，并趋向于沉降在人体呼吸道内的相同区域。一般认为，AED小于15㎛的粒子可进入呼吸道，其中10～15㎛的粒子主要沉积在上呼吸道，因此把直径小于15㎛（C对ABD错）的尘粒称为可吸入性粉尘；5㎛以下的粒子可到达呼吸道深部和肺泡区，称之为呼吸性粉尘。